初孕妇，28岁。妊娠36周，血压升高3周，今晨突然腹痛，呈持续性，阵发性加重。BP150/98mmHg，心率112次/分，尿蛋白（++），阴道少量流血。此时对诊断最有价值的辅助检查是
A. 眼底检查
B. B型超声检查
C. 肝功能检查
D. 白细胞计数
E. 血细胞比容

正确答案：B。B型超声检查

解析：青年初孕妇，妊娠36周（妊娠28周及以后称为妊娠晚期），血压升高3周，尿蛋白（＋＋）（妊娠期高血压可有血压升高，尿蛋白出现，妊高症是胎盘早剥的常见病因），今晨突然腹痛，呈持续性，阵发性加重（Ⅱ度胎盘早剥常有突然发生的持续性腹痛），该孕妇可诊断为胎盘早剥。B型超声检查（B对）可协助了解胎盘的部位及胎盘早剥的类型，并可明确胎儿大小及存活情况，最有诊断价值。眼底检查（A错）对妊娠期高血压的病情估计和诊疗方法有重要意义。肝功能检查（C错）对HELLP综合征的诊断有重要意义。白细胞计数（D错）为一般性检查。血细胞比容（E错）对妊娠期贫血有重要意义。